休克初期（微循环缺血性缺氧期）其微循环改变的病理生理学基础是：
A. 有效循环血量减少
B. 外周阻力增高
C. 血管床容积扩大
D. 毛细血管前阻力增高
E. 血流速度减慢

正确答案：D。毛细血管前阻力增高

解析：休克初期（微循环缺血性缺氧期）全身小血管，包括小动脉、微动脉、后微动脉、毛细血管前括约肌和微静脉、小静脉都发生收缩痉挛，口径明显变小，毛细血管前阻力增高（D对ABCE错），大量真毛细血管网关闭，微循环内血液流速减慢，轴流消失，血细胞出现齿轮状运动。